男，40岁农民。因发热伴全身不适头痛4天，少尿半天，于1月10日来诊，家中卫生条件差，有鼠，查体：T39.5度，P120次/分，BP80/50mmHg，神志清楚，腋下皮肤散在出血点，面颈部充血，眼睑水肿，颈无抵抗，Kerning征（-）。实验室检查：WBC21×10⁹/L，N0.7，异型淋巴细胞0.15，Hbl60g/L，Plt90x10⁹/L，尿蛋白（+++）。镜检有红细胞及管型，最可能的诊断是
A. 流行性脑脊髓膜炎
B. 钩端螺旋体病
C. 流行性感冒
D. 败血症
E. 肾综合征出血热

正确答案：E。肾综合征出血热

解析：40岁男性患者，职业农民（男性青壮年农民高发），家中卫生条件差，有鼠（接触鼠类可能性大），1月份（流行性出血热高发季节）因发发热伴全身不适头痛4天入院（流行性出血热发热期全身中毒症状），T39.5℃（发热），P120次/分，BP80/50mmHg（低血压），神志清楚，腋下皮肤散在出血点，面颈部充血，眼睑水肿（毛细血管损害征），颈无抵抗，Kerning征（-）；实验室检查：WBC21×l09/L（成人正常参考值4～10×l09/L），N0.7，异型淋巴细胞0.15（较多的异性淋巴细胞），Hbl60g/L，Plt90×l09/L（成人正常参考值100～300×l09/L）；尿蛋白（+++），镜检有红细胞及管型（肾损害征），根据患者的临床症状、体征和实验室诊断，结合流行性出血热的流行病学特征，该患者最可能的诊断是肾综合征出血热（E对），本病的主要变化是全身小血管和毛细血管广泛性损害，临床上以发热、低血压休克、充血出血和肾损害为主要表现。流行性脑脊髓膜炎（A错）的病原菌是脑膜炎奈瑟菌，儿童易感，前驱期主要表现为上呼吸道症状，败血症期可见高热寒战，伴有明显的全身中毒症状，精神极度萎靡，可见皮肤瘀斑瘀点。钩端螺旋体病脑膜炎型（B错）为钩端螺旋体感染后中期器官损伤期，在起病后3～10天出现严重头痛、烦躁等脑膜炎症状以及嗜睡、神志不清、昏迷等脑炎表现，而早期钩端螺旋体主要表现为全身感染中毒症状。人流行性感冒（C错）的病原体是流感病毒，人群普遍易感，表现为高热、乏力、头痛、全身肌肉酸痛等中毒症状。败血症（D错）临床表现无特异性，可反复出现的畏寒甚至寒战，高热可呈弛张型或间歇型，以瘀点为主的皮疹，累及大关节的关节痛，轻度的肝脾大，重者可有神志改变、心肌炎、感染性休克、DIC、呼吸窘迫综合征等，外周血白细胞升高，各种不同致病菌所引起的败血症，临床特点各不相同。流行性出血热发热期临床表现总结口诀如下：“发热三红醉酒貌，头腰眼痛像感冒，腋下鞭击出血点，恶心呕吐蛋白尿”。